口腔黏膜的痛觉分布不均匀，以下有关无痛区的相关描述中正确的是
A. 与第一磨牙相对的颊黏膜区有触觉感受点而无痛觉感受点
B. 与第一磨牙相对的颊黏膜区有痛觉感受点而无触觉感受点
C. 与第二磨牙相对的颊黏膜区有痛觉感受点而无触觉感受点
D. 与第三磨牙相对的颊黏膜区有触觉感受点而无痛觉感受点
E. 自颊侧黏膜中央至口角的一段带状区痛觉较迟钝

正确答案：E。自颊侧黏膜中央至口角的一段带状区痛觉较迟钝

解析：口腔黏膜的痛觉分布不均匀，与第二磨牙相对的颊黏膜区有触觉感受点而无痛觉感受点，自颊侧黏膜中央至口角的一段带状区痛觉较迟钝，称为无痛区。掌握“口腔感觉”知识点。